可以由皮肤合成的维生素是
A. 维生素C
B. 维生素B₁
C. 维生素E
D. 维生素A
E. 维生素D

正确答案：E。维生素D